地高辛的不良反应是
A. 高尿酸血症
B. 房室传导阻滞
C. 窦性心动过速
D. 停药反跳
E. 血管神经水肿

正确答案：B。房室传导阻滞

解析：本题考查地高辛。地高辛的不良反应有室性早搏、室上性心动过速、房室传导阻滞（B对）和心电图的改变。地高辛对心功能不全患者有利尿作用，不会有高尿酸血症（A错）。地高辛服用时间过长可能引起窦性心动过缓（C错），此项可作为停药指征之一。停药反跳（D错）和血管神经水肿（E错）不是地高辛的不良反应。